不属于中鼻道的结构是
A. 鼻泪管开口
B. 上颌窦开口
C. 半月裂孔
D. 筛漏斗
E. 筛泡

正确答案：A。鼻泪管开口

解析：鼻泪管属于下鼻道的结构（A错，为本题正确答案）。上颌窦（B对）、半月裂孔（C对）、筛漏斗（D对）、筛泡（E对）属于中鼻道的结构。